不具有杀虫消积功效的药物是
A. 使君子
B. 苦楝皮
C. 槟榔
D. 雷丸
E. 榧子

正确答案：B。苦楝皮

解析：苦楝皮苦寒有毒，有较强的杀虫作用，可治多种肠道寄生虫病，为广谱驱虫中药，还能治疗疥癣瘙痒，没有消积的作用（B对）；使君子，雷丸既能驱虫，也能治疗小儿疳积（AD错）；槟榔对多种寄生中都有驱杀作用，并以泻下作用驱除虫体为其优点，也能消积导滞，治疗积滞泻痢（C错）；槟榔既能杀虫消积，润肠通便，且甘平而不伤胃，对多种肠道寄生虫引起的虫积腹痛均可使用，又能消疳积，治疗小儿疳积腹痛有虫者（E错）。